病程进展很快，多数牙齿在短期内同时患龋，包括不易患龋的下前牙，这种类型的龋病称为
A. 继发性龋
B. 潜行性龋
C. 慢性龋
D. 猛性龋
E. 深龋

正确答案：D。猛性龋

解析：本题考查龋病的分类。病程进展很快，多数牙齿在短期内同时患龋，包括不易患龋的下前牙，这种类型的龋病称为猛性龋（D对）。猛性龋是急性龋的一种类型，病程进展较快，多数牙在短期内同时患龋，常见于颌面及颈部接受放射治疗的患者。龋病治疗后，由于充填物边缘或窝洞周围牙体组织破裂，形成菌斑滞留区，或修复材料与牙体组织不密合，留有小的缝隙，这些都可能成为致病条件，产生龋病，称继发龋（A错）。有的窝沟龋损呈锥形，底部朝牙本质，尖向釉质表面，狭而长的窝沟处损害更为严重，龋病早期，釉质表面无明显破坏。具有这类临床特征的龋损又称潜行性龋（B错）。慢性龋进展慢，龋坏组织染色深，呈黑褐色，病变组织较干硬（C错）。龋病进展到牙本质深层时为深龋（E错）。